患儿，3岁。自汗明显，伴盗汗，汗出以头部、肩背明显，动则益甚。面色少华，少气乏力，平时容易感冒，舌淡苔少，脉细弱。其证候是
A. 表虚不固
B. 营卫不和
C. 气阴虚弱
D. 心脾两虚
E. 肝肾阴虚

正确答案：A。表虚不固

解析：小儿自汗明显，伴盗汗，汗出以头部、肩背明显，动则益甚，是由于阳主卫外而固密，肺主皮毛，肺卫不固，津液不藏，故汗出；头为诸阳之会，肩背属阳，故汗出以头部、肩背明显。动则气耗，津液随气泄，故汗出更甚。神疲乏力，面色少华，是由气阳不足，津液亏损所致；肺卫失固，腠理不密，外邪乘袭，故常易感冒。舌质淡，脉细弱为气阳不足之象。故可诊断为汗证之表虚不固（A对）。营卫不和之汗证以汗出遍身而抚之不温为特点（B错）。气阴虚弱之汗证以盗汗为主（C错）。心脾两虚以心悸怔忡、失眠多梦、健忘、食少、腹胀等心血不足和脾气虚弱症为特征（D错）。肝肾阴虚证以头晕目眩、目干、容易疲劳、口燥咽干、失眠多梦、遗精、腰膝酸痛等肝阴虚和肾阴虚症为特征（E错）。